可与头孢他啶组成复方制剂，对大部分产碳青霉烯酶的细菌有抗菌活性的β内酰胺酶抑制剂是
A. 克拉维酸
B. 舒巴坦
C. 阿维巴坦
D. 他唑巴坦
E. 万巴巴坦

正确答案：C。阿维巴坦

解析：本题考查头孢菌素的复方制剂。与头孢他啶组成复方制剂的是阿维巴坦（C对），两者组成头孢他啶阿维巴坦。